抑制髓袢升支粗段的Na⁺-K⁺-2Cl⁻同向转运系统的药物是
A. 氢氯噻嗪
B. 呋塞米
C. 螺内酯
D. 甘露醇
E. 氨苯蝶啶

正确答案：B。呋塞米

解析：本题考查呋塞米的作用机制。抑制髓袢升支粗段的Na⁺-K⁺-2Cl⁻同向转运系统的药物是呋塞米（B对）。呋塞米为高效能利尿药，主要作用部位在髓袢升支粗段，干扰Na⁺-K⁺-2Cl⁻共同转运系统，产生强大的利尿作用。氢氯噻嗪（A错）为中效能利尿药。螺内酯（C错）是醛固酮受体拮抗剂。甘露醇（D错）为渗透性利尿药。氨苯蝶啶（E错）为保钾利尿药（低效能利尿药）。